根据《药品不良反应报告和监测管理方法》应由卫生行政部门给予行政处分的是
A. 医疗机构未按照要求开展药品不良反应或药品群体不良事件包括，调查，评价和处理
B. 医疗机构不配合严重药品不良反应和药品群体不良反应事件相关调查
C. 医疗机构无专职或兼职人员负责本单位的药品不良反应应监测工作
D. 医疗机构没有向相关部门提交定期安全性更新报告

正确答案：A、B、C。医疗机构未按照要求开展药品不良反应或药品群体不良事件包括，调查，评价和处理；医疗机构不配合严重药品不良反应和药品群体不良反应事件相关调查；医疗机构无专职或兼职人员负责本单位的药品不良反应应监测工作

解析：本题考查《药品不良反应报告和监测管理办法》。根据《药品不良反应报告和监测管理方法》应由卫生行政部门给予行政处分的是医疗机构未按照要求开展药品不良反应或药品群体不良事件包括，调查，评价和处理（A对）；医疗机构不配合严重药品不良反应和药品群体不良反应事件相关调查（B对）；医疗机构无专职或兼职人员负责本单位的药品不良反应应监测工作（C对）。《药品不良反应报告和监测管理办法》第七章法律责任第六十条：医疗机构有下列情形之一的，由所在地卫生行政部门给予警告，责令限期改正；逾期不改的，处三万元以下的罚款。情节严重并造成严重后果的，由所在地卫生行政部门对相关责任人给予行政处分：（一）无专职或者兼职人员负责本单位药品不良反应监测工作的；（二）未按照要求开展药品不良反应或者群体不良事件报告、调查、评价和处理的；（三）不配合严重药品不良反应和群体不良事件相关调查工作的。药品监督管理部门发现医疗机构有前款规定行为之一的，应当移交同级卫生行政部门处理。卫生行政部门对医疗机构作出行政处罚决定的，应当及时通报同级药品监督管理部门。《药品不良反应报告和监测管理办法》第七章法律责任第五十八条：药品生产企业有下列情形之一的，由所在地药品监督管理部门给予警告，责令限期改正，可以并处五千元以上三万元以下的罚款：（一）未按照规定建立药品不良反应报告和监测管理制度，或者无专门机构、专职人员负责本单位药品不良反应报告和监测工作的；（二）未建立和保存药品不良反应监测档案的；（三）未按照要求开展药品不良反应或者群体不良事件报告、调查、评价和处理的；（四）未按照要求提交定期安全性更新报告的（D错）；（五）未按照要求开展重点监测的；（六）不配合严重药品不良反应或者群体不良事件相关调查工作的；（七）其他违反本办法规定的。药品生产企业有前款规定第（四）项、第（五）项情形之一的，按照《药品注册管理办法》的规定对相应药品不予再注册。